病者因劳累汗出感寒，出现发热恶寒，腹满头痛身痛，大便已4日未行，舌红苔黄腻，脉浮而滑数，但饮食如故，治当选用
A. 厚朴三物汤
B. 大柴胡汤
C. 大承气汤
D. 柴胡桂枝汤
E. 厚朴七物汤

正确答案：E。厚朴七物汤

解析：病腹满，发热十日，说明腹满出现在发热之后。病十日，脉不浮紧而浮数，腹部又见胀满，可见病情不完全在表，已趋向于里、并且里证重于表证。饮食如故，表示病变重点不在胃，而在肠。证系太阳表证未解兼见阳明腑实。故用表里双解的厚朴七物汤治疗（E对）。